治疗皮肤黏膜淋巴结综合征卫气同病，应首选
A. 银翘散
B. 清瘟败毒饮
C. 白虎汤
D. 新加香薷饮
E. 凉膈散

正确答案：A。银翘散

解析：皮肤黏膜淋巴结综合征卫气同病证治宜辛凉透表，清热解毒，故选银翘散（A对）。清瘟败毒饮功能清气凉营，解毒化瘀，为皮肤黏膜淋巴结综合征气营两燔证的选方（B错）。白虎汤功能清热生津，主治气分热盛证（C错）。新加香薷饮功能祛暑解表，清热化湿，主治暑温夹湿，复感于寒证（D错）。凉膈散功能泻火通便，清上泄下，主治上中二焦邪郁生热证（E错）。